多用于精神分裂症的药物是
A. 酚噻嗪类药物
B. 抑制5-HT再摄取的药物
C. 苯二氮草类药物
D. 锂盐
E. 卡马西平

正确答案：A。酚噻嗪类药物

解析：吩噻嗪类药物（A对）（氯丙嗪是典型的代表）是抗精神病药物，多用于精神分裂症，能够显著缓解阳性症状，如进攻、妄想、幻觉等。抑制5-HT再摄取的药物（B错）通过增加突触间隙的5-HT而发挥抗抑郁作用，是抗抑郁药物。苯二氮草类药物（C错）主要用于焦虑症、失眠症、癫痫。锂盐（D错）主要用于抗躁狂但有时对抑郁症也有效，有情绪稳定剂。卡马西平（E错）是广谱抗癫痫药，是治疗单纯性局限性发作和大发作的首选药之一，同时还有抗复合性局限性发作和小发作的作用。